去除血液中白细胞可有效预防的输血不良反应是
A. 非溶血性发热性输血反应
B. 过敏反应
C. 细菌污染反应
D. 急性（即发性）溶血性输血反应
E. 迟发性溶血性输血反应

正确答案：A。非溶血性发热性输血反应

解析：血中的白细胞导致输血不良反应的机制为：与原来机体中的白细胞抗体发生抗原抗体反应而出现发热反应，因此去除白细胞可以预防非溶血性发热性输血反应（A对）。过敏反应（B错）是由血中蛋白类物质或IgA抗体引发，与白细胞无关。细菌污染反应（C错）是由细菌污染引起，预防措施应为严格无菌操作。溶血性输血反应（DE错）是因为输入血型不合的血液，核对血型、尽量同型输血、保证红细胞的完整才是有效预防溶血性输血反应的措施。